氢氧化铝的含量测定
A. 使用EDTA滴定液直接滴定，铬黑T作指示剂
B. 使用EDTA滴定液直接滴定，二甲酚橙作指示剂
C. 先加入一定量、过量的EDTA滴定液，再用锌滴定液回滴，二甲酚橙作指示剂
D. 先加入一定量、过量的EDTA滴定液，再用锌滴定液回滴，铬黑T作指示剂
E. 用锌滴定液直接滴定，用铭黑T作指示剂

正确答案：C。先加入一定量、过量的EDTA滴定液，再用锌滴定液回滴，二甲酚橙作指示剂